在碘酊处方中，碘化钾的作用是
A. 增溶
B. 着色
C. 乳化
D. 矫味
E. 助溶

正确答案：E。助溶

解析：本题考查碘化钾的作用。碘化钾有助于碘在酒精中的溶解，在碘酊处方中属于助溶剂（E对）。